基因诊断、治疗的有益于病人伦理原则对医务人员的严格要求是
A. 其他疗法无效而只有基因治疗有效
B. 在动物实验的基础上，对其适用于人体的疗效与危险做出评估且结果证明预期疗效大于危险
C. 保证新基因正确插入靶细胞、保持足够长的时间且充分发挥作用，还要保证它在细胞内有适当水平的表达
D. 将治疗方案报请有关部门审批
E. 以上条件都满足，确保基因治疗对病人有利

正确答案：E。以上条件都满足，确保基因治疗对病人有利